女，55岁，近1月来头痛、乏力、早醒、坐立不安常担心家人会出事，怀疑自己得了不治之症，给家庭带来麻烦，悲观失望。最可能的诊断是
A. 神经衰弱
B. 焦虑症
C. 抑郁症
D. 疑病症
E. 癔症

正确答案：C。抑郁症

解析：该病例患者近一月来（病程持续时间大于两周）以坐立不安、怕给家里带来麻烦（自责），悲观失望（情感低落）为主要表现，故诊断为抑郁发作（C对）。神经衰弱的患者长期处于紧张和压力下，表现为精神易兴奋和脑力易疲乏，常伴有情绪烦恼、易激惹等，无情感低落症状，与本例不符（A错）。焦虑症以焦虑为主要临床表现，常常有不明原因的提心吊胆、紧张不安，与本例不符（B错）。疑病性神经症（疑病症）病前常有过分关注自身健康，可表现为全身不适，疼痛，常四处求医但查无实据，与本例不符（D错）。